男，56岁。2年来表现为烦渴多食、多饮、多尿，体重下降，疲倦无力，注意力不集中，失眠，情绪低落，主动性差，反应迟钝。1周前出现兴奋不安，言语紊乱而住院。该患者最重要的治疗是
A. 应用肾上腺皮质激素
B. 补充雌激素
C. 控制精神症状
D. 补充甲状腺素
E. 控制血糖

正确答案：E。控制血糖

解析：患者为中年男性，有烦渴多食、多饮、多尿，体重下降（三多一少），伴中枢神经系统症状，考虑患者为糖尿病并神经系统并发症。1周前出现兴奋不安，言语紊乱（意识障碍），患者最可能的诊断是糖尿病所致精神障碍，最重要的治疗是控制血糖（E对）。